“阴阳离决，精气乃绝”所反映的阴阳关系是
A. 对立制约
B. 相互转化
C. 相互交感
D. 消长平衡
E. 互根互用

正确答案：E。互根互用

解析：阴阳互藏互根的意义，在于阴阳始终处于统一体之中，每方都以对方的存在作为自身存在的前提和条件，任何一方都不能脱离对方而单独存在（E对）。阴阳对立制约的意义在于防止阴阳的任何 方不至于亢盛为害，以维持阴阳之间的协调平衡（A错）。阴阳转化，指事物的阴阳属性，在一定条件下可以向其相反的方向转化，即属阳的事物可以转化为属阴的事物，属阴的事物可以转化为属阳的事物（B错）。阴阳交感，指阴阳二气在运动中相互感应而交合的相互作用（C错）。阴阳消长，指阴阳双方不是静止不变的，而是处千不断的消减和增加的运动变化之中。正是由于阴阳的消长变化，自然万物才能够维持相对、动态的平衡（D错）。